对多个样本均数进行两两比较的q检验，以下正确的一项是
A. 两均数之差越大，所用的临界值越小
B. 两对比组之间包含的组数越多，所用的临界值越小
C. 计算检验统计量q的分母不同
D. 均数之差小的对比组经检验有显著性，不一定均数之差大的对比组也有显著性
E. 如果有6个均数需要对比，则对比组之间包含的最大组数为4

正确答案：D。均数之差小的对比组经检验有显著性，不一定均数之差大的对比组也有显著性